治疗慢性支气管炎肝火犯肺证，应首选
A. 四逆散合左金丸
B. 泻白散合黛蛤散
C. 柴胡疏肝散
D. 清金化痰汤
E. 桑白皮汤

正确答案：B。泻白散合黛蛤散

解析：泻白散合黛蛤散加减可以清肺泻肝，顺气降火，用于治疗慢性支气管炎肝火犯肺证（B对）。四逆散合左金丸（A错）用于治疗阳郁厥逆证。柴胡疏肝散（C错）用于治疗肝郁气滞证。清金化痰汤（D错）用于治疗痰热壅肺证。桑白皮汤（E错）用于治疗痰热郁肺证。